假阴性率也称为
A. 灵敏度
B. 特异度
C. 漏诊率
D. 误诊率
E. 约登指数

正确答案：C。漏诊率